有关酶竞争性抑制剂特点的叙述，错误的是
A. 抑制剂与底物结构相似
B. 抑制剂与底物竞争酶分子中的活性中心
C. 当抑制剂存在时，Km值变大
D. 抑制剂恒定时，增加底物浓度，能达到最大反应速度
E. 抑制剂与酶共价结合

正确答案：E。抑制剂与酶共价结合

解析：酶竞争性抑制剂与底物结构相似（A对），可与底物竞争酶分子中的底物结合部位（B对），进而起到抑制作用。当抑制剂存在时Km值变大（C对）、Vmax不变。抑制剂与酶非共价结合（E错，为本题正确答案），这种结合是可逆的，因此增加底物的浓度可以减弱竞争性抑制作用，当底物浓度远远大于抑制剂浓度时，抑制剂的抑制作用几乎为零，因此可以通过增加底物浓度的方式达到最大反应速度（D对）。